不同性质的噪声对人听觉器官的损害特点是
A. 脉冲声比稳态声危害大、间断声比持续声危害大
B. 脉冲声比稳态声危害大、间断声比持续声危害小
C. 脉冲声比稳态声危害小、间断声比持续声危害小
D. 脉冲声比稳态声危害小、间断声比持续声危害大
E. 稳态声及持续声危害大、脉冲声及间断声危害小

正确答案：B。脉冲声比稳态声危害大、间断声比持续声危害小

解析：本题考查噪声对人听觉器官的损害。接触时间和接触方式以及噪声性质都会对人体造成损害。同样强度的噪声，接触时间越长对人体影响越大；连续接触噪声比间断接触对人体影响更大；脉冲噪声比稳态噪声危害大（B对ACDE错）。如果接触噪声的声级、时间等条件相同，暴露脉冲噪声的劳动者耳聋、高血压及中枢神经系统功能异常等发病率均较接触稳态噪声者高。